下列关于奥美拉唑的说法，不正确的是
A. 作用机制为抑制胃黏膜壁细胞H⁺-K⁺-ATP酶活性
B. 作用机制为阻断胃黏膜壁细胞上胃泌素受体
C. 治疗消化性溃疡病复发率低
D. 临床用于治疗胃和十二指肠溃疡、反流性食道炎、卓-艾综合征
E. 不良反应有头痛和胃肠道症状，偶有皮疹、肝功能异常及男性乳房女性化

正确答案：B。作用机制为阻断胃黏膜壁细胞上胃泌素受体

解析：奥美拉唑是H⁺-K⁺-ATP酶抑制药（A对），具有强大而持久的抑制胃酸分泌的作用，临床上主要用来治疗胃和十二指肠溃疡、反流性食道炎和卓-艾综合征等疾病（D对）。奥美拉唑是治疗消化性溃疡的首选药物，复发率低（C对），不良反应很少，偶见恶心、呕吐、腹胀、便秘、腹泻、头痛、皮疹、肝功能异常及男性乳房女性化等（E对）。作用机制为阻断胃黏膜壁细胞上胃泌素的药物主要是丙谷胺，与胃泌素竞争胃泌素受体，有抑制胃酸分泌的作用。